患者，女，30岁，已婚。怀孕3个月，近3天尿频、尿急、尿道灼热刺痛，两颧潮红，五心烦热，舌红苔薄黄，脉细滑数。治疗应首选
A. 五皮饮
B. 加味五苓散
C. 知柏地黄汤
D. 六味地黄汤
E. 导赤散

正确答案：C。知柏地黄汤

解析：患者妊娠3个月，近三天尿频尿急尿道灼热刺痛，是因为阴虚内热，津液亏耗，膀胱气化不利；并伴两颧潮红，五心烦热，舌红苔薄黄，脉细滑数的阴虚内热之象，故用知柏地黄丸滋阴清热，润燥通淋（C对）。五皮饮功效利水消肿，理气健脾，用于脾虚湿盛，气滞水泛之皮水证，常见一身悉肿，肢体沉重，心腹胀满，上气喘急，小便不利，妊娠水肿，苔白腻，脉沉缓之象（A错）。加味五苓散功效清热利湿，润燥通淋，用于妊娠小便淋漓，湿热下注证，常表现为尿意不尽，欲解不能，小便短赤，小腹坠胀，胸闷纳少等湿热内盛之证（B错）。六味地黄汤功效滋补肝肾，用于肝肾阴虚证常见腰膝酸软，头晕目眩，耳鸣耳聋，骨蒸潮热，手足心热，口燥咽干，牙齿摇动，足跟作痛，小便淋沥等肝肾阴虚之象（D错）。导赤散功效清心泻火，润燥通便，用于妊娠小便淋漓心火偏亢证，常见尿短赤，艰涩刺痛，面赤心烦，渴喜冷饮，甚至口舌生疮等心火偏旺之证（E错）。